长期接触石棉粉尘最易发生的恶性肿瘤是
A. 胃癌
B. 肺癌和间皮瘤
C. 淋巴瘤
D. 肝血管肉瘤
E. 肝癌

正确答案：B。肺癌和间皮瘤

解析：本题考查石棉的致癌种类。石棉是公认的致癌物，石棉纤维在肺中沉积可导致肺癌和恶性间皮瘤（B对ACDE错）。石棉不仅危害接尘工人，而且因其使用广泛而污染大气和水源，危害广大居民。1.肺癌，石棉接触者或石棉肺病人肺癌发生率显著增高。2.间皮瘤，间皮瘤分良性和恶性两类，石棉接触与恶性间皮瘤有关。